白喉治疗用
A. 活疫苗
B. 死疫苗
C. 类毒素
D. 抗毒素
E. 转移因子

正确答案：D。抗毒素